某新生儿出生7天被确诊为化脓性脑膜炎，下述哪种是最常见的致病菌
A. 脑膜炎奈瑟菌
B. 流感杆菌
C. 肺炎球菌
D. 金黄色葡萄球菌
E. B组链球菌

正确答案：D。金黄色葡萄球菌

解析：2个月以下幼婴和新生儿以及原发性或继发性免疫缺陷病者，易发生肠道革兰阴性杆菌和金黄色葡萄球菌脑膜炎，该新生儿出生7天，最常见的致病菌应该是肠道革兰阴性杆菌和金黄色葡萄球菌（D对）。脑膜炎奈瑟菌（A错）、流感杆菌（B错）、肺炎球菌（C错）引起的化脓性脑膜炎占2/3，但该新生儿不属于此群体。B组链球菌（E错）在我国较少引起颅内感染。